与1型糖尿病人牙周破坏严重程度有关的因素是
A. 糖尿病的类型
B. 代谢控制的程度
C. 糖尿病病程的长短
D. 有无全身并发症
E. 以上均是

正确答案：E。以上均是

解析：本题考查与1型糖尿病人牙周破坏严重程度有关的因素。糖尿病伴发牙周病的病理机制可能是白细胞趋化和吞噬功能缺陷，牙周炎已经被提出是糖尿病的第六并发症，糖尿病的类型（A对）、代谢控制的程度（B对）、糖尿病病程的长短（C对）、有无全身并发症（D对）均可影响1型糖尿病人牙周破坏严重程度（ABCD均对，故E为本题的正确答案）。